良性前列腺增生的病理特点
A. 腺体、平滑肌、纤维均增生
B. 基质增生
C. 血管增生
D. 上皮细胞增生
E. 腺上皮化生

正确答案：A。腺体、平滑肌、纤维均增生

解析：前列腺增生的成分主要由纤维、平滑肌和腺体组成（A对BCDE错）。